医师在执业活动中不属于应当履行的义务是
A. 宣传普及卫生保健知识
B. 尊重患者隐私权
C. 人格尊严人身安全不受侵犯
D. 努力钴研业务，及时更新知识
E. 爱岗敬业，努力工作

正确答案：C。人格尊严人身安全不受侵犯

解析：人格尊严、人身安全不受侵犯（C错，为本题正确答案）属于医师在执业活动中应当享有的权利，而不是履行的义务。《执业医师法》规定，医师在执业活动中应当履行下列义务：①遵守法律、法规，遵守技术操作规范；②爱岗敬业，努力工作（E对），履行医师职责，尽职尽责为患者服务；③关心、爱护、尊重患者隐私权（B对）；④努力钻研业务，及时更新知识（D对），提高专业技术水平；⑤宣传普及卫生保健知识（A对）。